失活干髓术干髓剂处方中不含有
A. 多聚甲醛
B. 麝香草酚
C. 羊毛脂
D. 氧化锌
E. 碘甘油

正确答案：E。碘甘油

解析：本题考查牙髓失活剂的成分。使牙髓失活的药物称为牙髓失活剂，分为砷失活剂和多聚甲醛失活剂。失活剂中不含有碘甘油（E错，为本题的正确答案）。多聚甲醛失活剂含有多聚甲醛（A对）、麝香草酚（B对）、羊毛脂（C对）和氧化锌（D对）等。砷失活剂含有金属砷、可卡因等。